以下龋病类型中，按损害程度分类的是
A. 中龋
B. 急性龋
C. 窝沟龋
D. 静止龋
E. 慢性龋

正确答案：A。中龋

解析：根据病变侵入牙齿的深度分类：临床上以去除龋腐后洞底所在的组织位置分为浅、中、深龋。掌握“龋病的临床表现与分类”知识点。